微波对眼的主要危害是
A. 结膜炎
B. 晶体混浊
C. 角膜炎
D. 视网膜灼伤
E. 视网膜剥离

正确答案：B。晶体混浊

解析：本题考查微波对眼的危害。微波是波长在1mm～1m的电磁波，微波对于眼部的影响主要是微波辐射引起的眼晶状体浑浊（B对ACDE错），少数接触大功率微波辐射者，甚至可发展为白内障。此外，职业性微波辐射暴露人群一般主诉非特性性类神经征和心悸、心前区疼痛或胸闷感等。